阑尾的位置变化较大，但最为多见的是
A. 盆位
B. 盲肠后位
C. 盲肠下位
D. 回肠前位
E. 回肠后位

正确答案：B。盲肠后位

解析：阑尾与回肠盲肠的位置关系有回肠下，盲肠后（B错），盲肠下（C错），回肠前（D错）和回肠后位（E错）等，根据调查，以回肠下位及盲肠后位(B对)最为多见。